渗透泵型控释剂的具有高渗透压的渗透促进剂
A. 醋酸纤维素
B. 乙醇
C. 聚氧化乙烯（PEO）
D. 氯化钠
E. 1.5%CMC-Na溶液

正确答案：D。氯化钠

解析：本题考查渗透促进剂。渗透泵片的常用渗透压活性物质有氯化钠（D对）、乳糖、果糖、葡萄糖、甘露醇的不同混合物。醋酸纤维素（A错）为渗透泵型控释制剂常用的半透膜材料。乙醇（B错）是一种有机物，俗称酒精，常用于制造醋酸、饮料、香精、燃料、燃料等。聚氧化乙烯（PEO）（C错）为渗透泵片的推动剂。1.5%CMC-Na溶液（E错）为葡萄糖聚合度为100～2000的纤维素衍生物，在食品工业中用作增稠剂，医药工业中用作药物载体，日用化学工艺中用作黏合剂、抗再沉剂。